下列反映疾病发生频率的指标是
A. 某病死亡率
B. 某病病死率
C. 发病率
D. 治愈率
E. 因病（伤）缺勤率

正确答案：C。发病率